帽状期牙胚片状的牙板向内凹陷形成的充满结缔组织的腔隙
A. 无釉柱釉质
B. 釉板
C. 釉索
D. 釉龛
E. 釉结

正确答案：D。釉龛

解析：本题考查成釉器的发育-帽状期。帽状期牙胚片状的牙板向内凹陷形成的充满结缔组织的腔隙称为釉龛（D对）。无釉柱釉质（A错）、釉板（B错）为牙体硬组织结构。釉索为釉结节处从内釉上皮延伸至外釉上皮的条索结构（C错）。釉结为帽状期牙胚内釉上皮中央簇状未分化上皮细胞（E错）。